诊断慢性根尖周炎或慢性根尖周炎急性发作的重要指标
A. X线片检查可见根尖部和根分歧部牙槽骨破坏的透射影像
B. 乳牙牙周组织疏松
C. 患牙松动并有叩痛
D. 出现较剧烈的自发痛
E. 根尖部或根分歧处牙龈红肿

正确答案：A。X线片检查可见根尖部和根分歧部牙槽骨破坏的透射影像

解析：X线片检查可见根尖部和根分歧部牙槽骨破坏的透射影像，是诊断慢性根尖周炎或慢性根尖周炎急性发作的重要指标。急性根尖周炎时X线片根尖部无明显改变或仅有牙周间隙增宽现象。另外X线片检查中，还需注意牙囊骨壁和恒牙胚是否受损。掌握“乳牙牙髓病及根尖周病诊断及治疗”知识点。